男，50岁，2个月来间歇性无痛性全血尿，近3天来加重伴有血块，B型超声双肾正常，膀胱内有1.5cm×2.0cm×l.0cm新生物，有蒂，为明确诊断最重要的检查是
A. 尿常规
B. 尿脱落细胞检查
C. 膀胱镜检
D. 静脉尿路造影
E. CT

正确答案：C。膀胱镜检

解析：中年男性患者，间歇性无痛性全血尿、伴有血块（提示可能有泌尿系肿瘤），B型超声双肾正常（可排除肾肿瘤），膀胱内有一带蒂的新生物（提示可能为膀胱肿瘤），结合患者病史、临床表现和B超检查，该患者最可能的诊断为膀胱肿瘤。为明确诊断最重要的检查是膀胱镜检（C对），膀胱镜检可以直接观察肿瘤所在部位、大小、数目和形态，同时获取活体组织标本，可为膀胱肿瘤的确诊提供重要依据。尿常规（A错）为泌尿系疾病患者的一般常规检查，无特异性。尿脱落细胞检查（B错）为泌尿系肿瘤常用的筛查手段。静脉尿路造影（D错）主要用于显示有无尿路梗阻、了解分侧肾功能，多用于尿路结石的诊断。CT（E错）主要用于了解膀胱癌晚期对周围组织侵犯和盆腔淋巴结转移的情况。